关于腹膜腔的说法，正确的是
A. 由浆膜围成
B. 由黏膜围成
C. 由腹壁围成
D. 腹膜腔即腹腔
E. 呈负压

正确答案：A。由浆膜围成

解析：腹膜腔由浆膜形成的壁腹膜和脏腹膜围成(A对BC错)，腹膜腔与腹腔是不同概念(D错)，腹膜腔呈常压(E错)。